下列细菌属于红色复合体的是
A. 直肠弯曲菌
B. 中间普氏菌
C. 具核梭杆菌
D. 齿垢密螺旋体
E. 血链球菌

正确答案：D。齿垢密螺旋体

解析：本题考查属于红色复合体的细菌。下列细菌属于红色复合体的是齿垢密螺旋体（D对）。属于红色复合体的细菌有牙龈卟啉单胞菌、福塞斯坦纳菌和齿垢密螺旋体。